核酸对紫外线的最大吸收峰是
A. 220nm
B. 240nm
C. 260nm
D. 280nm
E. 300nm

正确答案：C。260nm

解析：核酸对紫外线的最大吸收峰为260nm（C对），蛋白质对紫外线的最大吸收峰为280nm（D错），茚三铜缩合成的蓝紫色化合物最大吸收峰为570nm（P11）。